牙髓治疗的方法包括以下各项，除外
A. 活髓保存疗法
B. 根尖诱导形成术
C. 根管治疗术
D. 龈下刮治术
E. 牙髓塑化法

正确答案：D。龈下刮治术

解析：本题考查牙髓治疗的方法。牙髓治疗的方法包括以下各项，除外龈下刮治术（D错，为本题的正确答案）。龈下刮治属于牙周治疗中的基础治疗，属牙周治疗。活髓保存法主要包括盖髓术和牙髓切断术，均属牙髓治疗（A对）。根尖诱导成形术是指牙根未完全成形前，发生牙髓严重病变或根尖周炎症的年轻恒牙，在消除感染或治愈根尖周炎的基础上，用药物诱导根尖部的牙髓和根尖周组织形成硬组织，使牙根继续发育和根尖孔缩小或封闭的治疗方法,属于牙髓治疗（B对）。根管治疗术是通过机械清洗和化学消毒的方法预备根管，将牙髓腔内的病原刺激物清除，经过对根管的清理、成形，必要的药物消毒，以及严密充填，达到消除感染，堵塞、封闭根管空腔，消灭细菌的存在空间，防止再次感染的目的（C对）。牙髓塑化治疗是将未聚合的塑料注入根管内，使之渗透到残存的牙髓组织及髓腔内感染物中，和这些物质一齐聚合，达到消除病源刺激物的作用。残存牙髓被塑化后，就保持无菌状态，变成为对人体无害的物质，为牙髓治疗（E对）。